一侧肾结核，上肾盏有虫蚀样改变，应采用
A. 抗结核治疗
B. 病灶清除术
C. 肾部分切除术
D. 肾切除术
E. 肾造瘘

正确答案：A。抗结核治疗

解析：一侧肾结核，上肾盏有虫蚀样改变，说明肾结核尚处于早期，因此首选的治疗方法是抗结核治疗（A对），在正确应用抗结核药物治疗后多能治愈。病灶清除术（B错）适用于肾实质表面闭合性的、与集合系统不相通的局灶性结核脓肿；肾部分切除术（C错）适用于结核病灶局限于肾的一极的患者；肾切除术（D错）主要用于肾结核破坏严重而对侧肾正常者；肾造瘘术（E错）主要用于患肾功能丧失、对侧肾积水严重的患者。